阻止微管蛋白双微体聚合和诱导微管的解聚
A. 喜树碱
B. 硫酸长春碱
C. 多柔比星
D. 紫杉醇
E. 盐酸阿糖胞苷

正确答案：D。紫杉醇

解析：本题考查紫杉醇的作用机制。紫杉醇（D对）能够使微管蛋白和组成微管的微管蛋白二聚体失去动态平衡，诱导与促进微管蛋白聚合、微管装配、防止解聚，从而使微管稳定并抑制癌细胞的有丝分裂和触发细胞凋亡，进而有效阻止癌细胞的增殖，起到抗癌作用。